有助于预防缺铁性贫血的食物是
A. 牛奶
B. 鸡蛋
C. 精粉
D. 动物内脏
E. 苹果

正确答案：D。动物内脏